患者，男，30岁。便干，便后出血并疼痛1周。检查：肛门外观可见截石位6点有一梭形裂口通向肛内，创面不深，边缘整齐。其分类应是
A. 内痔
B. 外痔
C. 肛窦炎
D. 早期肛裂
E. 陈旧性肛裂

正确答案：D。早期肛裂

解析：该患者便干、便血，检查可见：肛门外观可见截石位6点有一梭形裂口通向肛内，创面不深，边缘整齐，符合早期肛裂的特点（D对）。内痔可见肛门齿状线以上、直肠末端黏膜下的痔内静脉丛扩大曲张和充血所形成的柔软静脉团，患者未见（A错）。外痔是发生于齿状线以下，是由痔外静脉丛扩大曲张或痔外静脉丛破裂或反复发炎纤维增生而成的疾病。其表面被皮肤覆盖，不易出血。其临床特点是自觉肛门坠胀、疼痛，有异物感（B错）。肛窦炎是肛隐窝、肛门瓣发生的急、慢性炎症性疾病。常并发肛乳头炎、肛乳头肥大。其特点是肛门部不适和肛门潮湿有分泌物（C错）。陈旧性肛裂可见裂口、栉膜带、赘皮性外痔、单口内瘘、肛窦炎、肛乳头炎和肛乳头肥大（E错）。